以下哪项不是预防HIV的防治原则
A. 加强对AIDS的监测和疫情报告
B. 严格筛查血源
C. 加强对预防性传播疾病的健康教育
D. 预防职业暴露感染
E. 加强对犬等宠物的登记管理

正确答案：E。加强对犬等宠物的登记管理

解析：预防HIV感染的综合措施，目前尚无AIDS疫苗问世，宜采取综合性预防措施。其中包括：加强对AIDS的监测和疫情报告；严格筛查血源、人工受孕的精液、供移植的器官组织等；加强对预防性传播疾病（STD）的健康教育，提倡使用安全套和安全的性生活；预防职业暴露感染。掌握“人类免疫缺陷病毒”知识点。